18～64岁年龄组人群中推荐的身体活动量为
A. 每周至少3次高强度体力活动
B. 每天累计至少60分钟中等强度体力活动
C. 每周最多120分钟中等强度体力活动
D. 每周至少75分钟高强度有氧体力活动
E. 每周最多2天进行大肌群参与的强壮肌肉的活动

正确答案：D。每周至少75分钟高强度有氧体力活动

解析：18～64岁年龄组每周至少150分钟中等强度有氧体力活动，或每周至少75分钟高强度有氧体力活动。掌握“身体活动促进”知识点。